牙齿受外力作用而偏离，以致脱离牙槽窝者，称为
A. 牙折
B. 牙震荡
C. 牙脱位
D. 牙髓坏死
E. 牙骨质瘤

正确答案：C。牙脱位

解析：牙齿受外力作用而偏离，以致部分或全部脱离牙槽窝者，称为牙脱位。掌握“牙脱位”知识点。